能够自动获取外源DNA，使细胞获得新的遗传表型，此种作用称为
A. 接合作用
B. 转导作用
C. 转化作用
D. 重组作用
E. 转座作用

正确答案：C。转化作用

解析：通过自动获取或人为地供给外源DNA，是细胞或培养的受体细胞获得新的遗传表型，这就是转化作用。掌握“DNA重组与基因工程”知识点。